当细胞外Ca²⁺浓度降低时，主要引起心肌
A. 收缩力降低
B. 舒张期延长
C. 收缩力增强
D. 舒张期缩短
E. 传导速度加快

正确答案：A。收缩力降低